环境温度为21℃，机体处于不着衣和安静状态下的主要散热方式为
A. 辐射散热
B. 传导散热
C. 对流散热
D. 蒸发散热
E. 骨骼肌战栗

正确答案：A。辐射散热

解析：辐射散热是指机体通过热射线的形式将体热传给外界温度较低物质的一种散热方式。人体在21℃的环境中，在裸体情况下约有60%的热量是通过辐射方式发散的。故环境温度为21℃，机体处于不着衣和安静状态下的主要散热方式为辐射散热（A对）。传导散热是指机体的热量直接传给与之接触的温度较低物体的一种散热方式（B错）。对流散热是指通过气体流动而实现热量交换的一种散热方式（C错）。蒸发散热（D错）是指水分从体表汽化时吸收热量而散发体热的一种方式。蒸发散热可分为不感蒸发和发汗两种形式。不感蒸发是指体内的水从皮肤和黏膜（主要是呼吸道黏膜）表面不断渗出而被汽化的过程。由于这种蒸发不被人们所察觉，且与汗腺活动无关，故得此名，其中水从皮肤表面的蒸发又称不显汗。骨骼肌战栗（E错）是机体在寒冷环境中，成年人产热量大为增加的主要方式。